下列在体内具有生物功能的大分子中，属于Ⅰ相代谢酶的是
A. 拓扑异构酶
B. 葡萄糖醛酸转移酶
C. N-乙酰基转移酶
D. 血管紧张素转换酶
E. 混合功能氧化酶

正确答案：E。混合功能氧化酶

解析：本题考查Ⅰ相代谢酶。在体内具有生物功能的大分子中，属于Ⅰ相代谢酶的是混合功能氧化酶（E对）。第Ⅰ相反应是引入官能团的反应，通常是脂溶性药物经氧化、还原、水解和异构化，引入羟基、氨基或羧基等极性基团；第Ⅱ相反应是结合反应，含极性基团的原型药物或第Ⅰ相反应生成的代谢产物与机体内源性物质结合生成结合物。参与Ⅰ相反应的酶类主要是氧化-还原酶、还原酶和水解酶；参与Ⅱ相代谢酶包括葡萄糖醛酸转移酶（B错）、谷胱甘肽-S-转移酶、N-乙酰基转移酶（C错）等。